患者，女，48岁，因反复心悸就诊，心电图示心房颤动，拟施行药物转复，应选用的药物是
A. 胺碘酮
B. 氟桂利嗪
C. 硝酸异山梨酯
D. 呋塞米
E. 氨氯地平

正确答案：A。胺碘酮

解析：本题考查胺碘酮。胺碘酮（A对）为转复房颤的药物，静脉注射时转复房颤的成功率是34%～69%，口服胺碘酮转复成功率为15%～40%。氟桂利嗪（B错）用于脑供血不足，椎动脉缺血，脑血栓形成；耳鸣，脑晕；偏头痛预防；癫痫辅助治疗。硝酸异山梨酯（C错）用于冠心病的长期治疗，心绞痛的预防，心肌梗死后持续心绞痛的治疗。呋塞米（D错）可减轻心脏负荷。氨氯地平（E错）为二氢吡啶类抗高血压药物。